对我国目前的AIDS流行特征的描述错误的是
A. AIDS疫情仍呈上升趋势
B. 流行地区广泛，地区差异性大，疫情主要出现在农村和经济不发达地区
C. AIDS由一般人群向高危人群扩散
D. 三种传播途径并存，吸毒者和性传播是新发感染的主要途径
E. AIDS发病及死亡情况严重

正确答案：C。AIDS由一般人群向高危人群扩散